小儿特异性体液免疫的正确认识是
A. B细胞免疫的发育较T细胞免疫早
B. IgG类抗体应答需在出生1年后才出现
C. IgM类抗体在胎儿期即可产生
D. 足月新生儿B细胞量低于成人
E. 免疫球蛋白均不能通过胎盘

正确答案：C。IgM类抗体在胎儿期即可产生

解析：小儿特异性体液免疫的正确认识是：胎儿期已能产生IgM，出生后更快（C对），所以IgM类抗体在胎儿期即可产生。出生时T细胞自身发育已完善（八年制儿科学第二版P174），新生儿B细胞产生抗体的能力低下，出生后随年龄增长特异性体液免疫才逐步完善（A错）。新生儿自身合成的IgG比IgM慢，生后3个月血清IgG降至最低点，至10～12个月时体内IgG均为自身产生（B错）。足月新生儿B细胞数量高于成人，但产生 抗体的能力低下（D错）。IgG是唯一能通过胎盘的免疫球蛋白（E错）。